早期动脉粥样硬化病变，最早进入动脉内膜的细胞是
A. 红细胞
B. 淋巴细胞
C. 脂肪细胞
D. 嗜中性粒细胞
E. 巨噬细胞

正确答案：E。巨噬细胞

解析：根据动脉粥样硬化（AS）的内皮损伤学说可知，在AS的早期，多种因素可引起内皮细胞损伤，损伤后的内皮细胞将分泌生长因子，吸引单核细胞聚集并黏附于动脉内膜，随后转化为巨噬细胞（E对），经多种受体介导，与已进入内膜发生氧化的脂质形成单核巨噬细胞源性泡沫细胞。AS时无红细胞（A错）和脂肪细胞（C错）进入动脉内膜，在病变的逐渐发展过程中可见少量T淋巴细胞浸润（B错）和中性粒细胞（D错）。